患者，女，30岁。右下后牙遇甜食痛求诊。检查见右下第一磨牙龋坏，龋达牙本质浅层，冷热测同对照牙。右下第二磨牙（牙合）面窝沟色素沉着，龋损未达牙本质，冷测同对照牙。诊断为
A. 右下第一磨牙浅龋，右下第二磨牙中龋
B. 右下第一磨牙中龋、右下第二磨牙中龋
C. 右下第一磨牙中龋，右下第二磨牙浅龋
D. 右下第一磨牙浅龋，右下第二磨牙深龋
E. 以上均不正确

正确答案：C。右下第一磨牙中龋，右下第二磨牙浅龋

解析：龋坏进展到牙本质浅层，则可诊断为中龋，中龋：龋损的前沿位于牙本质的浅层，又称为牙本质浅龋。龋损聚集在牙釉质，则可判断浅龋，因浅龋龋损在釉质或根面牙骨质层内。掌握“龋病的诊断及鉴别诊断”知识点。